关于生理性黄疸，说法正确的是
A. 生后24h以内出现黄疸
B. 黄疸持续时间足月儿＞2周
C. 生后第2～3日出现黄疸
D. 足月儿血清总胆红素＞221μmol/L
E. 血清总胆红素每日上升幅度＞85.5μmol/L

正确答案：C。生后第2～3日出现黄疸

解析：该题考查新生儿生理性黄疸的特性。生理性黄疸大部分新生儿在出生后第2-3天出现黄疸（C对，且A错），于4-6天最重。足月儿在出生后10-14天消退（B错），早产儿可延迟至第3周才消退。在此期间，小儿一般情况良好，不伴有其他临床症状。血清总胆红素低于221μmol/L (12.9mg/dl)（DE错）。